生用燥湿利水，炒用健脾止泻的药物
A. 西洋参
B. 白术
C. 黄芪
D. 人参
E. 甘草

正确答案：B。白术

解析：白术的功效是健脾益气，燥湿利水，止汗，安胎；燥湿利水宜生用，补气健脾宜炒用，健脾止泻宜炒焦用（B对）。西洋参（A错）的功效是补气养阴，清热生津。黄芪（C错）的功效是补气升阳，固表止汗，利水消肿，生津养血，托毒排脓，敛疮生肌。人参（D错）的功效是大补元气，复脉固脱，补脾益肺，生津养血，安神益智。甘草（E错）的功效是补脾益气，清热解毒，祛痰止咳，缓急止痛，调和诸药。